釉珠附着在
A. 根尖牙骨质表面
B. 髓腔内壁
C. 近颈部牙骨质表面
D. 根管内壁
E. 牙冠表面

正确答案：C。近颈部牙骨质表面

解析：本题考查釉珠。釉珠是牢固附于牙骨质表面的釉质小块，大小似粟粒，多位于磨牙根分叉内或其附近，或釉牙骨质界附近的根面上，即近颈部牙骨质表面（C对）。